阳明温病，津液不足，无水舟停者，间服增液，再不下者，治疗宜选
A. 羚角钩藤汤加紫雪丹
B. 犀角地黄汤
C. 增液承气汤
D. 牛黄承气汤
E. 安宫牛黄丸

正确答案：C。增液承气汤

解析：吴氏认为：“下而至于不通，其为危险可知。”病至阳明，用攻下法，是治疗外感热病的关键点，在此失治，则土实而水亏，水亏则木旺，液涸风动，种种险候，可以接踵而至。“下之不通，其证有五”，说明单纯用攻下法未能取效，应考虑有其他病理因素存在。阴液亏损，“无水舟停”出现便秘，当给予增液汤“增水行舟”，滋阴通便。服两剂后大便仍不下者，乃因兼夹腑实，可用增液承气汤（C对）滋阴攻下，此为一腑中“气血合治法”。